下列哪项是《中华人民共和国宪法》规定的内容
A. 不分种族、宗教、政治信仰、经济和社会状况享有最高的、可获得的健康标准是每个人的基本权利之一
B. 人人有权享受为维持他本人和家属的健康和福利所需的生活水准
C. 在遭受失业、疾病、残废、守寡、衰老或在其他不能控制的情况下丧失谋生能力时，有权享受保障
D. 在年老、疾病或者丧失劳动能力的情况下，有从国家和社会获得物质帮助的权利
E. 每一个权利必须有最低的标准

正确答案：D。在年老、疾病或者丧失劳动能力的情况下，有从国家和社会获得物质帮助的权利

解析：《中华人民共和国宪法》第45条明确写到：“中华人民共和国公民在年老、疾病或者丧失劳动能力的情况下，有从国家和社会获得物质帮助的权利。国家发展为公民享受这些权利所需要的社会保险、社会救济和医疗卫生事业。”掌握“健康伦理”知识点。